平均粒重在3.0g以上栓剂的重量差异限度是
A. ±2%
B. ±5%
C. ±7.5%
D. ±10%
E. ±12.5%

正确答案：B。±5%